女，50岁。恶心、伴乏力、少尿6小时，呕吐量大，无口渴。2年前有腹部手术史。此时患者最可能出现的水电解质平衡紊乱是
A. 高渗性缺水
B. 稀释性低钠血症
C. 低渗性缺水
D. 等渗性缺水
E. 高钾血症

正确答案：D。等渗性缺水

解析：患者大量呕吐，有恶心、呕吐、乏力、少尿等症状，最可能出现的水电解质平衡紊乱应是等渗性缺水（D对）（等渗性缺水常由消化液急性丢失引起，常表现为恶心、厌食、乏力、少尿等，但不口渴）。高渗性脱水（P11）（A错）会有口渴。稀释性低钠血症（P13）（B错）又称水中毒，临床较少发生，患者多有摄入水分过多或接受过多的静脉输液等病史。低渗性缺水（P11）（C错）常由慢性病因引起。患者呕吐量大，钾随体液大量丢失，应出现低钾血症，而非高钾血症（E错）。